治疗疮疡久溃不敛，应首选
A. 灯草灸
B. 隔姜灸
C. 隔蒜灸
D. 隔盐灸
E. 隔附子饼灸

正确答案：E。隔附子饼灸

解析：疮疡久溃不敛，治疗应扶正，用隔附子饼灸，有温补肾阳，补正祛邪，增加抗病能力的作用，故首选隔附子饼灸（E对）。灯草灸（A错）主要用于小儿痄腮、喉蛾、吐泻、麻疹、惊风等病证。隔姜灸（B错）适用于一切虚寒病证，对呕吐、腹痛、泄泻、遗精、阳痿、早泄、不孕、痛经和风寒湿痹等疗效较好。隔蒜灸（C错）多用于治疗肺结核、腹中积块及未溃疮疡等。隔盐灸（D错）有回阳、救逆、固脱之功，常用于治疗急性腹痛、吐泻、痢疾、淋病、中风脱证等。